为缓解腹膜炎症和减缓腹部术后病人腹膜对有害物质的吸收，病人多采取什么体位？
A. 俯卧位
B. 右侧卧位
C. 左侧卧位
D. 半卧位
E. 无

正确答案：D。半卧位

解析：只有当半卧位（D对，为本题正确答案）时,有害液体会流至下腹部,避开吸收能力较强的上腹部的腹膜，以减缓腹膜对有害物质的吸收。